B1细胞所不具备的抗体应答特点是
A. 识别并结合多糖抗原而被激活
B. 接受抗原刺激后，相应抗体可在48小时内产生
C. 产生的抗体以IgM为主
D. 产生的抗体以IgG为主
E. 不产生免疫记忆

正确答案：D。产生的抗体以IgG为主